眶下神经阻滞麻醉口内注射时注射针与上颌中线成
A. 15°
B. 30°
C. 45°
D. 60°
E. 90°

正确答案：C。45°

解析：眶下神经阻滞麻醉口内注射法：牵引上唇向前向上，注射针与上颌中线成45°角，于侧切牙根尖相应部位的口腔前庭沟顶刺入，向上后外进针，即可到达眶下孔，但不易进入眶下管。掌握“颌面部常用局麻法及牙拔除的麻醉选择”知识点。